面颈部的血液供应主要来源于
A. 颈内动脉和甲状腺上动脉
B. 颈内动脉和舌动脉
C. 颈内动脉和颌外动脉
D. 颈内动脉和颌内动脉
E. 颈总动脉和锁骨下动脉

正确答案：E。颈总动脉和锁骨下动脉

解析：面颈部的血液供应主要来源于颈总动脉和锁骨下动脉。掌握“颈内外动脉主要分支及分布”知识点。